某男患痛风2年余，最近检查发现罹患高血压，医生建议其降低食盐摄入，目的是避免发生
A. 关节损害
B. 肝脏损害
C. 中枢神经系统损害
D. 肾脏损害
E. 循环功能障碍

正确答案：D。肾脏损害

解析：本题考查建议痛风伴有高血压病人降低食盐摄入量的原因。痛风病人多伴有高血压，宜采用少盐饮食。食盐摄入过多后尿钠增加，在肾内与尿酸结合为尿酸钠，后者易沉积于肾脏，造成肾脏损害（D对ABCE错）。